尿量为多少时，表明休克已经纠正
A. 60ml/h
B. 50ml/h
C. 30ml/h
D. 25ml/h
E. 20ml/h

正确答案：C。30ml/h

解析：本题考查休克。当尿量维持在30ml/h（C对）以上时，表明休克已经纠正。